下列有关口腔颌面部感染常见致病菌的相关叙述中，正确的是
A. 常由金黄色葡萄球菌、溶血性链球菌、大肠杆菌等引起
B. 多为需氧菌与厌氧菌的混合感染
C. 可分为化脓性和特异性两大类
D. 近年来类杆菌属、梭杆菌属等检出率也极高
E. 以上说法均正确

正确答案：E。以上说法均正确

解析：口腔颌面部感染常由金黄色葡萄球菌、溶血性链球菌、大肠杆菌等引起。近年来，由于应用厌氧培养技术，在口腔颌面部感染中还可检出厌氧菌，如类杆菌属、梭杆菌属、消化链球菌等检出率也极高，说明目前口腔颌面部感染最多见的是需氧菌与厌氧菌的混合感染。随着广谱抗生素的广泛应用，诸如耐甲氧西林金葡菌等耐药菌株引起的感染亦日益增多。掌握“口腔颌面部感染概论”知识点。